血糖仪的选购和使用注意事项不正确的是
A. 应选择经过药品监督管理部门注册批准的产品
B. 使用前应仔细阅读使用说明书，在专业人员指导下使用
C. 更换新批号试条时，一定要先用制造商提供的校准试条或质控液进行校准后再测血糖
D. 患者购买和使用时一定要注意标签上的有效期，并注意按规定温度保存
E. 血糖试条可以和任何的血糖仪一起使用

正确答案：E。血糖试条可以和任何的血糖仪一起使用

解析：本题考查血糖仪的选购和使用注意事项。血糖仪的使用注意事项包括：血糖试纸必须和其适配的血糖仪一起使用，购买时要购买和血糖仪相适应的试纸（E错，为本题正确答案）。